下列有关遗传密码的叙述哪一项是不正确的
A. 在mRNA信息区，由5'→3'端每相邻的三个核苷酸组成的三联体称为遗传密码
B. 在mRNA信息区，由3'→5'端每相邻的三个核苷酸组成的三联体称为遗传密码
C. 生物体细胞内存在64个遗传密码
D. 起始密码是AUG遗传密码
E. 终止密码为UAA、UAG和UGA

正确答案：B。在mRNA信息区，由3'→5'端每相邻的三个核苷酸组成的三联体称为遗传密码